在配对比较符号秩和检验时，有两个差数绝对值相等，符号相反，且是绝对值最小的两个差数，则编秩时应分别编为
A. -1和2
B. 1和-2
C. 1和2
D. 1.5和-1.5
E. 1.5和1.5

正确答案：D。1.5和-1.5